下列不属于栓剂的质量要求的是
A. 外观完整光滑
B. 有适宜的硬度
C. 崩解时限应符合要求
D. 无刺激性
E. 塞入腔道后应能融化、软化或溶解

正确答案：C。崩解时限应符合要求

解析：本题考查栓剂的质量要求。崩解时限（C错，为本题正确答案）不是栓剂的质量要求，栓剂的质量要求包括：①药物与基质应混合均匀，栓剂外形应完整光滑（A对），无刺激性（D对）。②塞入腔道后，应能融化、软化或溶解（E对）。③有适宜的硬度（B对）。④制备栓剂用的固体药物，应预先制成细粉或最细粉。根据使用腔道和目的不同，制成适宜的形状。⑤栓剂所用内包装材料应无毒性。⑥阴道膨胀栓内芯应符合有关规定。⑦除另有规定外，栓剂应进行重量差异、融变时限的检查；阴道膨胀栓应进行膨胀值的检查；栓剂的微生物限度应符合规定。